易侵犯下部的邪气是
A. 湿
B. 寒
C. 暑
D. 风
E. 燥

正确答案：A。湿

解析：湿邪特点之一：湿性趋下，易袭阴位。湿邪类水属阴而有趋下之势，多易伤及人体下部（A对）。寒（B错）为阴邪，易伤阳气；寒性凝滞；寒性收引。暑（C错）为阳邪，其性炙热；暑性升散，易扰心神；暑多夹湿，具有一定的季节性。风（D错）性轻扬开泄，易袭阳位，常袭击上部，头面，咽喉。燥（E错）性干燥，易伤津液；燥易伤肺。